职业医疗机构的医生的工作牌上面有
A. 姓名
B. 职称
C. 职务
D. A+B
E. A+B+C

正确答案：E。A+B+C

解析：本题考查医疗机构执业。职业医疗机构的医生的工作牌上面有姓名、职称、职务（E对）。